28岁妇女，主诉白带增多，检查宫颈阴道部宫口周围外观呈细颗粒状红色区，占整个宫颈面积的2/3，宫颈刮片巴氏染色Ⅱ级。本例恰当处置应是
A. 涂硝酸银腐蚀
B. 阴道内放置药物
C. 物理治疗
D. 宫颈锥形切除
E. 宫颈切除

正确答案：C。物理治疗

解析：该患者宫颈刮片巴氏染色Ⅱ级，属良性改变或炎症，一般会自然消退，故恰当的处理是物理治疗（C对）。涂硝酸银腐蚀（A错）主要用于杀菌。阴道内放置药物（B错）主要用于阴道炎症。宫颈锥形切除（D错）、宫颈切除（E错）用于阴道镜检查不满意的CINⅡ和所有CINⅢ的患者（P303）。